瘀血所致出血的特点是
A. 出血量多
B. 血色鲜红
C. 夹有血块
D. 伴有疼痛
E. 伴有肿胀

正确答案：C。夹有血块

解析：该题考查瘀血致病的特点。瘀血所致的出血特点为血色紫黯，或夹有瘀血块（C对）；血热动血可见各种出血，以来势较急，血色鲜红最多为特点（AB错）。血寒的形成，多因外感寒邪，侵犯血分；或阳气失于温煦所致临床表现常以血脉瘀滞而引起局部疼痛为特征（D错），伴见手足、爪甲、皮肤及舌色青紫等症状。